当样本含量固定时，第一类错误α和第二类错误β的关系有
A. α愈大，β可能愈大
B. α﹥β
C. α＜β
D. α愈大，β可能愈小
E. α＝β

正确答案：D。α愈大，β可能愈小

解析：当样本含量固定时，第一类错误α和第二类错误β的关系：α指越小，β越大；反之α愈大，β可能愈小（D对）。